卡托普利的降血压机制
A. 抑制肾素的合成
B. 抑制肾素的释放
C. 抑制血管紧张素Ⅰ合成酶
D. 抑制血管紧张素转化酶
E. 以上均非

正确答案：D。抑制血管紧张素转化酶

解析：卡托普利通过抑制ACE，拮抗血管紧张素Ⅰ转换为血管紧张素Ⅱ，从而扩张血管，使血压下降（D对）。